吗啡作用于延髓孤束核阿片受体引起
A. 镇咳
B. 瞳孔缩小
C. 欣快感
D. 外周血管扩张
E. 恶心、呕吐

正确答案：A。镇咳

解析：本题考查吗啡。吗啡作用于延髓孤束核（咳嗽反射中枢）阿片受体，可镇咳（A对）；作用于中脑盖前核阿片受体（δ受体），引起血压下降、缩瞳（B错）；作用于边缘系统阿片受体（μ₁受体），可镇痛，引起欣快感（C错）；作用于外周血管上的吗啡受体可扩张外周血管（D错）；作用于脑干极后区阿片受体（μ₂受体），引起胃肠道抑制反应，产生恶心、呕吐（E错）。